以上辅料中，属于缓（控）缓释剂不溶性骨架材料的是
A. 乙基纤维素
B. 蜂蜡
C. 微晶纤维素
D. 羟丙甲纤维素
E. 硬酯酸镁

正确答案：A。乙基纤维素

解析：本题考查缓释固体分散体常用的载体材料。不溶性骨架材料是指不溶于水或水溶性极小的高分子聚合物或无毒塑料等。常用的有乙基纤维素（EC）（A对）、聚乙烯、无毒聚氯乙烯、乙烯-醋酸乙烯共聚物、硅橡胶等。蜂蜡（B错）为溶蚀性骨架材料。微晶纤维素（C错）是片剂常用的填充剂，不属于骨架材料的范畴。羟丙甲纤维素（D错）为亲水凝胶骨架材料。硬脂酸镁（E错）是片剂常用的润滑剂，不属于缓控释骨架材料的范畴。